对组织性缺氧最有诊断价值的是
A. 动-静脉血氧含量差
B. 动脉血氧含量
C. 动脉血氧容量
D. 动脉血氧饱和度
E. 动脉血氧分压

正确答案：A。动-静脉血氧含量差

解析：组织性缺氧时动脉血氧分压（E错）、动脉血氧含量（B错）、动脉血氧容量（C错）、动脉血氧饱和度（D错）均正常，而动-静脉血氧含量差减小，故动-静脉血氧含量差（A对）是组织性缺氧最具有诊断价值的指标。